临床治疗绿脓杆菌感染可选用的抗生素是
A. 氨苄西林
B. 阿莫西林
C. 替卡西林
D. 苯唑西林
E. 青霉素V

正确答案：C。替卡西林